糖尿出现时，全血血糖浓度至少为
A. 83.33mmol/L（1500mg/dl）
B. 66.67mmol/L（1200mg/dl）
C. 27.78mmol/L（500mg/dl）
D. 11.11mmol/L（200mg/l）
E. 8.89mmol/L（160mg/dl）

正确答案：E。8.89mmol/L（160mg/dl）

解析：糖尿出现时说明血糖浓度超过肾糖阈，此时全血血糖浓度至少应为160mg/100ml～180mg/100ml（8.89~10mmol/L）（100ml=1dl）（E对）。